左侧外侧膝状体与下述哪项有关
A. 两眼视野的鼻侧半有关
B. 两眼视野的颞侧半有关
C. 两眼视野的左侧半有关
D. 两眼视网膜的右侧半有关
E. 两眼视野右侧半有关

正确答案：E。两眼视野右侧半有关

解析：外侧膝状体参与视觉的传导。一个眼球的视网膜节细胞发出的轴突汇集成视神经，经视交叉后形成视束，最后投射到外侧膝状体。因此，左侧视束内含有来自两眼视网膜左侧半的纤维，右侧视束内含有来自两眼视网膜右侧半的纤维。故左侧外侧膝状体和两眼视野的左侧半有关（C对）。